患者18岁，在治疗其他牙时，发现右上2畸形舌侧窝，深，可卡探针，温度测同对照牙。该牙的处理应为
A. 不治疗
B. 预防性充填
C. 直接盖髓
D. 活髓切断术
E. 根管治疗

正确答案：B。预防性充填

解析：本题考查牙内陷的治疗。患者18岁，在治疗其他牙时，发现右上2畸形舌侧窝，深，可卡探针，温度测同对照牙。该牙的处理应为预防性充填（B对）。畸形舌侧窝由于舌侧窝呈囊状深陷，容易滞留食物残渣，利于细菌滋生，再加上囊底存在发育上的缺陷，常引起牙髓的感染、坏死及根尖周病变。病例中的畸形舌侧窝，深，可卡探针，温度测同对照牙，则考虑患牙畸形舌侧窝未引起牙髓炎症症状，但由于其比较深，存在发育缺陷，容易患龋引起牙髓感染，因此可以对患牙的畸形舌侧窝进行预防性充填，防止其继发龋病。畸形舌侧窝较浅，不易滞留食物继发龋病者可不治疗（A错）。患牙温度侧同对照牙，说明损坏较浅，距牙髓较远，窝洞清理干净后不会露髓，不必行直接盖髓术（C错）。患牙温度测验同对照牙，说明牙髓正常，无牙髓感染情况，且患者18岁，右上2牙根已发育完成，不需活髓切断术（D错）。患牙牙髓反应正常，无牙髓病变，无需做根管治疗（E错）。